CD4⁺Th1细胞诱导的炎症中直接造成细胞浸润的主要细胞因子是
A. IFN-γ
B. TNF﹢IFN-γ﹢IL-2
C. IL-4
D. IL-12
E. IL-8

正确答案：B。TNF﹢IFN-γ﹢IL-2